男，24岁。阵发性心悸3年，突发突止，每次持续0.5～3小时不等，无头晕和黑矇。发作时查体：BP120/70mmHg，心率180次/分，律齐。心电图示QRS波群形态和时限正常。该患者心悸发作时，下列可首选的治疗是
A. 口服β受体拮抗剂
B. 静脉注射西地兰
C. 静脉注射腺苷
D. 口服地高辛
E. 静脉注射利多卡因

正确答案：C。静脉注射腺苷

解析：阵发性室上性心动过速若心功能与血压正常，可先尝试刺激迷走神经的方法。包括颈静脉窦按摩、Valsalva等。若效果不佳，首选的治疗药物为腺苷（C对），如腺苷无效可改静注维拉帕米或地尔硫䓬。当患者出现严重心绞痛、低血压、充血性心力衰竭表现，应立即电复律。β受体拮抗剂（A错）（P193）也能有效终止心动过速，但应避免用于失代偿的心力衰竭、支气管哮喘患者，并以选用短效β受体拮抗剂如艾司洛尔较为合适，故不作为首选药物。美西律（P206）（B错）为ⅠB类抗心律失常药，适用于急、慢性室性快速性心律失常，常用于小儿先天性心脏病与室性心律失常。地高辛（D错）属于洋地黄类药物（P172），最适合用于伴有快速心房颤动/心房扑动的收缩性心力衰竭；静脉注射洋地黄可终止阵发性室上速发作，目前洋地黄已较少应用，但对伴有心功能不全患者仍作首选。利多卡因（九版药理学P195）（E错）主要治疗室性心律失常，如心脏手术、心导管术、急性心肌梗死或强心苷中毒所致的室性心动过速或心室纤颤。